属于自然绝经的是
A. 医源性因素丧失卵巢功能后月经终止
B. 生理性卵巢功能丧失而导致月经终止
C. 子宫切除导致月经终止
D. 子宫内膜结核导致月经终止
E. 营养不良导致月经终止

正确答案：B。生理性卵巢功能丧失而导致月经终止

解析：本题考查自然绝经的相关内容。自然绝经是指由于卵巢内卵泡活动的丧失引起月经永久停止（B对ACDE错），无明显病理原因。连续12个月无月经后才可确定为绝经。由于没有明确的生物学指标可预测最终月经，只能做回顾性地认定。